下列哪种作用是以DNA为靶的化学诱变作用
A. 对有丝分裂作用的干扰
B. 对DNA合成酶系的破坏
C. 对DNA复制酶系的破坏
D. 以上都不是

正确答案：D。以上都不是

解析：本题考查以DNA为靶的诱变作用。以DNA为靶的诱变作用有：1.碱基烷化；2.碱基类似物取代；3.碱基结构破坏；4.平面大分子嵌入DNA链；5.二聚体形成；6.DNA加合物形成；7.DNA-蛋白质交联分子形成。对有丝分裂作用的干扰；对DNA合成酶系的破坏；对DNA复制酶系的破坏（D对ABC错）均属于不以DNA为靶的诱变作用。